脂质体的膜材是
A. 微球
B. pH敏感脂质体
C. 磷脂和胆固醇
D. 毫微粒
E. 单室脂质体

正确答案：C。磷脂和胆固醇

解析：本题考查脂质体。脂质体的膜材主要由磷脂与胆固醇（C对）构成。磷脂包括天然的卵磷脂、脑磷脂、豆磷脂以及合成磷脂等，均可用作脂质体双分子层基本材料。胆固醇具有调节膜流动性的作用，是脂质体的“流动性缓冲剂”。微球（A错）是指药物溶解或者分散在高分子材料基质中形成的微小球状实体。pH敏感脂质体（B错）是用含有pH敏感基团的脂质制备的，在低pH时脂肪酸度基质子化而引起六角相形成，导致膜融合而达到细胞内靶向和控制药物释放的功能性脂质体。毫微粒（D错）为以天然或合成高分子物体为载体制成的载药微细粒。单室脂质体（E错）为球径约≤25nm，药物的溶液只被一层类脂质双分子层所包封的脂质体。